粉尘对人体有下列作用
A. 致纤维化
B. 刺激
C. 中毒
D. 致敏
E. 以上全部

正确答案：E。以上全部

解析：本题考查的是生产性粉尘对机体的影响。生产性粉尘对机体的损害是多方面的，直接的健康损害以呼吸系统损害为主，局部以刺激和炎性作用为主。肺尘埃沉着病（俗称尘肺）是由于在环境中长期吸入生产性粉尘而引起的以肺组织纤维化为主的疾病。有机粉尘的生物学作用不同于无机粉尘，当吸入带有霉菌孢子的植物性粉尘、如草料尘、粮谷尘、蔗渣尘等，或者吸入被细菌或血清蛋白污染的有机粉尘可引起过敏性肺炎。粉尘吸附或者含有的可溶性有毒物质如含铅、砷、锰等，可在呼吸道黏膜很快溶解吸收，呈现出相应毒物的急性中毒症状（E对ABCD错）。